化妆品的生物性污染主要是指
A. 细菌和病毒污染
B. 细菌和金属污染
C. 细菌和虫媒污染
D. 细菌和真菌污染
E. 真菌和病毒污染

正确答案：D。细菌和真菌污染